男性，55岁。巩膜皮肤黄染进行性加重2月余，胆囊肿大呈圆形，可推动，无触压痛。首先考虑的疾病是
A. 胆囊癌
B. 急性胆囊炎
C. 胆囊结石
D. 急性病毒性肝炎
E. 胰头癌

正确答案：E。胰头癌

解析：中年男性患者，巩膜皮肤黄染进行性加重2月余（进行性加重的黄疸为胰头癌的典型症状），胆囊肿大呈圆形、可推动、无触压痛（Courvoisier征，胰头癌的典型体征）。综合患者的症状、体征，首先考虑的疾病是胰头癌（E对）。胆囊癌（九版外科学P453）（A错）主要表现为腹痛、恶心、呕吐等；急性胆囊炎（九版外科学P444）（B错）胆囊肿大呈囊性，并有明显压痛；胆囊结石（九版外科学P439）（C错）通常是在饱餐、进食油腻食物后或睡眠中改变体位时发生右上腹阵发性绞痛或呈持续性疼痛阵发性加重并向右肩背部放射，一般不会出现巩膜皮肤黄染进行性加重。急性病毒性肝炎（九版传染病P35）（D错）主要表现为黄疸、腹痛、恶心、呕吐等症状，一般不会出现胆囊肿大、可推动、无触压痛的体征。